对异丙嗪，哪项错误
A. 是H₁受体阻断药
B. 有明显的中枢抑制作用
C. 能抑制胃酸分泌
D. 有抗过敏作用
E. 有止吐作用

正确答案：C。能抑制胃酸分泌